关于乡村功能分区的卫生学要求，正确的是
A. 乡村规划用地的布局要以方便村民生产为主要原则
B. 乡村各功能分区的布置要尽量紧凑，以节约土地
C. 饲养区应尽量布置在居民区附近，以方便村民管理
D. 功能接近的建筑要尽量集中，避免功能不同的建筑混杂布置
E. 工业区应布置在居住区的上风向，河流下游

正确答案：D。功能接近的建筑要尽量集中，避免功能不同的建筑混杂布置

解析：本题考查乡村功能分区的卫生学要求。乡村规划用地的布局要根据其功能进行合理的功能分区（AB错）；公共建筑应按照各自的功能合理布置；功能接近的建筑要尽量集中，避免功能不同的建筑混杂布置（D对）。饲养区应配置在居民点外围，居住区下风侧和河流下游（C错）。工业区对环境影响较大，应布置在当地主导风向的下风侧、河流的下游（E错）。